符合骨折功能复位标准的是
A. 允许下肢骨折存在与关节活动方向垂直的侧方成角
B. 儿童下肢骨干骨折缩短2cm以内
C. 骨折部分的旋转移位不必完全矫正
D. 复位后骨折断端对位达1/5
E. 骨折部分的分离移位不必完全矫正

正确答案：B。儿童下肢骨干骨折缩短2cm以内

解析：功能复位指经复位后，两骨折端虽未恢复至正常的解剖关系，但在骨折愈合后对肢体功能无明显影响。功能复位的标准要求骨折部位的旋转移位（C错）、分离移位（E错）必须完全矫正。儿童若无骨骺损伤，下肢缩短在2cm以内，可自行矫正（B对）。下肢骨折向侧方成角移位，与关节活动方向垂直，日后不能矫正，必须完全复位（A错）。否则关节内、外侧负重不平衡，易引起创伤性关节炎。长骨干横形骨折，骨折端对位至少达1/3（D错），干骺端骨折至少应对位3/4。